评价预防接种群体效果的免疫学指标是
A. 抗体阳转率
B. 保护率
C. 效果指数
D. 发病率
E. 病死率

正确答案：A。抗体阳转率